女，28岁，Graves病患者，应用国产丙基硫氧嘧啶+普萘洛尔治疗两周，病人出现低热乏力加重，咽痛。白细胞2.7×10⁹/L，粒细胞＜1.5×10⁹/L。下述哪种处置最为合适
A. 继续现有治疗
B. 改用进口丙基硫氧嘧啶
C. 维持现有治疗+升白细胞药
D. 改用放射性核素治疗
E. 停抗甲状腺药，升白药物及预防治疗感染

正确答案：E。停抗甲状腺药，升白药物及预防治疗感染

解析：本题甲亢患者由于服用国产丙基硫氧嘧啶+普萘洛尔治疗，出现了药物副作用，白细胞数减低和粒细胞减少，应当停用抗甲状腺药，升白药物及预防治疗感染（E正确）。粒细胞减少一旦发现应停用现用药物，并做紧急处理（A错）。进口药和国产药差别不大，显然不可改用进口药（B错）。如果仅仅出现白细胞低于4.0×10⁹/L时应密切观察，同时给予升白细胞药物治疗，但改患者出现粒细胞减少症，必须停用现服药物，并做紧急处理（C错）。在符合放射性治疗适应症的情况下可以考虑用放射性核素，但此时患者出现粒细胞减少症，应该紧急处理（D错）。